男性，23岁，学生，1周前因淋雨后感冒，自服康泰克后好转。3天前开始出现寒战、发热，伴右胸痛、右上腹痛而到校医务室就诊。查体：T39℃，全身皮肤无黄染，右下肺呼吸音减弱，未闻及干湿哕音，右上腹叩击痛（+），肝脾未触及，双肾区叩击痛（-）。WBC15×109/L，尿蛋白（+），尿沉渣涂片（-）。该患者最可能的诊断是
A. 肝脓肿
B. 肺脓肿
C. 急性尿路感染
D. 急性胆囊炎
E. 肺炎链球菌肺炎

正确答案：E。肺炎链球菌肺炎

解析：患者为青年急性发病，有明显受凉诱因后寒战、发热，伴全身肌肉酸痛，肺部有呼吸音减弱体征，血WBC及中性粒细胞均高，因此肺炎的可能性最大；肺炎链球菌肺炎炎症累及膈胸膜时可出现上腹部压痛，该患者虽然有右上腹叩击痛（+），但全身皮肤无黄染，肝脾未触及，故可暂时排除急腹症，肝脓肿、急性尿路感染、急性胆囊炎可排除；患者尿蛋白（+）可为高热所致，尿沉渣涂片（-），且无尿频、尿急、尿痛三联症，急性尿路感染可排除。掌握“肺炎”知识点。